决定恶性肿瘤治疗原则的因素一般不包括
A. 患者经济状况
B. 生长部位
C. 分化程度
D. 临床分期
E. 组织来源

正确答案：A。患者经济状况

解析：本题考查决定恶性肿瘤治疗原则的因素。患者经济状况不是决定因素（A错，为本题的正确答案）。恶性肿瘤应根据其组织来源（E对）、生长部位（B对）、分化程度（C对）、发展速度、临床分期（D对）、患者机体状况等全面研究，决定治疗方法。